患者女性，39岁。头痛3个月，加重伴间断性呕吐、抽搐、视物模糊1个月。查体：右上肢可见2个活动良好的椭圆形结节，眼底检查有视神经乳头水肿。最可能的诊断是
A. 隐球菌性脑膜炎
B. 脑肿瘤
C. 结核性脑膜炎
D. 癫痫
E. 囊尾蚴虫

正确答案：E。囊尾蚴虫